女婴，5个月。咳嗽伴发热三天，喘憋1天。无明显咳痰，体温波动在38℃～39℃，喘憋进行性加重。查体：T38.5℃，P150次/分，R60次/分，精神、反应可，双肺哮鸣音，双下肺可闻及细湿啰音，腹软，无明显压痛，肝肋下2cm。该病胸部X线片典型表现是
A. 均一片状阴影
B. 双肺纹理粗
C. 大小不等的片状阴影或融合成大病灶
D. 小点片状、斑片状阴影伴肺气肿
E. 肺浸润伴多发性肺脓肿、肺大疱

正确答案：D。小点片状、斑片状阴影伴肺气肿

解析：女婴，5个月（1岁以内的儿童是呼吸道合胞病毒肺炎的多发人群）。咳嗽伴发热三天，喘憋1天。无明显咳痰，体温波动在38℃-39℃，喘憋进行性加重（较明显的呼吸困难、憋喘、低中度发热是呼吸道合胞病毒肺炎的典型临床表现）。查体：T38.5℃，P150次/分，R60次/分，精神、反应可，双肺哮鸣音，双下肺可闻及细湿啰音（肺部听诊有中、细湿啰音是呼吸道合胞病毒肺炎的临床体征），腹软，无明显压痛，肝肋下2cm。综上所述，该患者最有可能的诊断是呼吸道合胞病毒肺炎，其X线表现为两肺可见小点片状、斑片状阴影，部分患儿有不同程度的肺气肿（D对），均一片状阴影（A错）为肺炎链球菌肺炎的X线表现，双肺纹理粗（B错）是支气管肺炎的早期临床表现，大小不等的片状阴影或融合大病灶（C错）为腺病毒肺炎的X线表现，肺浸润伴多发性肺脓肿、肺大疱（E错）是金黄色葡萄球菌的X线表现。